女，54岁。双腕、双手近端指间关节、掌指关节肿痛3年，晨僵1小时。查体：双腕、双手2～4掌指关节及3～4近端指间关节肿胀，压痛（+）；ANA（-）。该患者关节病变的基本病理特征是
A. 血管炎
B. 软骨炎
C. 滑膜炎
D. 附着点炎
E. 韧带炎

正确答案：C。滑膜炎

解析：中年女性患者，双腕、双手2～4掌指关节及3～4近端指间关节肿胀和压痛，晨僵1小时（类风湿性关节炎典型表现），结合患者症状、体征和实验室检查，该患者最可能的诊断是类风湿性关节炎。类风湿性关节炎的关节基本病变是滑膜炎（C对）。血管炎（A错）为其关节外的基本病变。软骨炎（B错）为骨关节炎基本病变。附着点炎（D错）为强直性脊柱炎的基本病变。韧带炎（E错）是一种慢性的不红不肿不发热有痛的无菌性炎症损伤，脊柱疾患是发生本病的常见原因。